下列哪项不属于消渴的并发症
A. 水肿
B. 中风
C. 肺痨
D. 痈疽
E. 咳嗽

正确答案：E。咳嗽

解析：消渴病因为阴虚燥热，常变证百出，如肺失滋润，日久可以并发为肺痨（C对）；肝肾阴虚，精血不能上承于耳目，可并发为白内障、雀盲、耳聋；燥热内结，营阴被灼，蕴毒成脓，可发为疮疖、痈疽（D对）；燥热内炽，炼液成痰，瘀阻经络，蒙蔽心窍，可致中风偏瘫（B对）；阴损及阳，脾肾阳虚，水湿内停，泛溢肌肤，可成水肿（A对）；若阴液极度虚耗，可致阴竭阳亡，而见昏迷、四肢厥冷、脉微欲绝的危像（E错，为本题正确答案）。